牙本质表面预处理应达到的目的
A. 彻底去除牙本质表面涂层及管塞
B. 扩大牙本质小管
C. 使用30％磷酸，使牙本质脱矿
D. 去除牙本质表面涂层，不去除管塞
E. 降低牙本质的可渗透性

正确答案：D。去除牙本质表面涂层，不去除管塞

解析：本题考查牙本质的表面预处理。表面预处理可以提高粘接效果。牙体预备时，由于车针的高速切割和挤压，会在牙本质表面形成厚1～5μm的玷污层（牙本质表面涂层），由无机物碎屑和凝固的胶原纤维碎屑组成，这些碎屑深入牙本质小管会形成管塞。牙本质表面涂层降低牙本质通透性，不利于粘接，应去除；但是管塞可以减少外界细菌的进入，保护牙髓，减少牙本质敏感，不应去除（D对A错）。牙本质预处理时使用30％的磷酸是为了去除玷污层而不是使牙本质脱矿（C错）、扩大牙本质小管（B错），去除玷污层可以提高牙本质的可渗透性（E错）利于粘结。